医疗机构贮存设备或者设施不符合环境保护、卫生要求的
A. 由县级以上地方人民政府卫生行政主管部门责令限期改正，给予警告，可以并处5000元以下的罚款
B. 由省（自治区）级以上人民政府责令限期改正，给予警告，可以并处5000元以下的罚款
C. 由县级以上地方人民政府卫生行政主管部门责令限期改正，给予警告，可以并处10000元以下的罚款
D. 由县级以上地方人民政府卫生行政主管部门责令限期改正，给予警告，暂不予罚款处理
E. 由省(自治区)级以上人民政府卫生行政部门责令限期改正，给予警告，可以并处5000元以下的罚款

正确答案：A。由县级以上地方人民政府卫生行政主管部门责令限期改正，给予警告，可以并处5000元以下的罚款